某垃圾填埋场渗沥水污染了地下水，而地下水的自净作用缓慢，其主要原因是
A. 有机物含量高
B. 有大量难分解的有机物
C. 没有阳光无法进行光解反应
D. 流动缓慢、溶解氧少
E. 温度较低

正确答案：D。流动缓慢、溶解氧少

解析：本题考查地下水自净作用缓慢的原因。地下水的自净作用是指地下水中的有机物和无机物被自然环境中的微生物、光解反应、氧化还原反应等进行分解，从而改善水质的过程。地下水的自净作用缓慢，主要是由于流动缓慢、溶解氧少（D对ABCE错）造成的。地下水的流动缓慢，会导致水中溶解氧的浓度降低，从而影响微生物的活性，降低有机物的分解速率，从而降低地下水的自净作用。此外，地下水的流动缓慢，也会导致有机物和无机物在地下水中的混合不均匀，从而影响微生物的活性，降低有机物的分解速率，从而降低地下水的自净作用。